女，28岁，初孕，平素月经规律，妊娠40周，孕期检查正常，今自觉胎动减少，查体：T36.0℃，P70次/分，R20次/分，BP110/70mmHg，超声检查：羊水最大暗区2.5cm，指数7.0m，检查：宫颈管未消，宫口未开，先露-3，胎心率120次/分。应进行的检查中不包括
A. 胎儿电子监护
B. 尿雌激素/肌酐比值
C. MRI
D. 胎儿生物物理评分
E. B超复查

正确答案：C。MRI

解析：成年女性患者，初孕，平素月经规律，妊娠40周，孕期检查正常，今自觉胎动减少，查体：T36.0℃（正常值36.0～37.0℃），P70次/分（正常值60～100次/分），R20次/分（正常值16～20次/分），BP110/70mmHg，超声检查：羊水最大暗区2.5cm（正常值3～8cm），指数7.0m（正常值5～18cm），检查：宫颈管未消，宫口未开，先露-3（胎头颅骨最低点在坐骨棘平面上3cm），胎心率120次/分（正常值110～160次/分）。MRI（C错，为本题正确答案）一般不用于胎儿宫内状况的监测。胎儿电子监护（A对）被广泛用于产前和产时的辅助检查手段。尿雌激素/肌酐比值（E/C）（B对）适用于评估胎儿胎盘单位功能。胎儿生物物理评分（D对）是综合电子胎心监护及超声检查所示某些生理活动，以判断胎儿有无急、慢性缺氧的一种产前监护方法，可供临床参考。B超复查（E对）可监测胎儿血流动力学，可以对有高危因素的胎儿状况做出客观判断。